初孕妇，孕38周，头痛，呕吐伴自觉胎动减少一天来院。血压24/14.4kPa(180/110mmHg)。尿蛋白(++)，尿E3：20.82μmol/24h(＜10mg/24h)，胎心130次/分，子宫颈管未消失。0CT呈频繁晚期减速(迟发性减速)，血细胞比容0.41，最适合的处理是
A. 静滴硫酸镁与肼苯达嗪控制病情
B. 硫酸镁+降压+扩容疗法控制病情
C. 积极治疗，48小时未能控制病情则行剖宫产
D. 破膜+静滴催产素引产
E. 积极药物治疗同时立即剖宫产

正确答案：E。积极药物治疗同时立即剖宫产

解析：24小时尿E3＞15mg为正常值，10～15为警戒值，＜10为危险值。本例＜10，故为危险值。0CT呈频繁晚期减速，说明胎儿缺氧。应立即终止妊娠，选E。掌握“娠期高血压疾病”知识点。